支气管哮喘属于下列哪型过敏反应
A. Ⅰ型
B. Ⅱ型
C. Ⅲ型
D. Ⅳ型
E. 迟发型超敏反应

正确答案：A。Ⅰ型

解析：支气管哮喘属于Ⅰ型过敏反应（A对）。Ⅱ型过敏反应一般包括输血反应、新生儿溶血症等（B错）。Ⅲ型过敏反应一般包括Arthus反应、链球菌感染导致的肾小球肾炎等（C错）。Ⅳ型过敏反应（迟发型超敏反应）一般包括结核病、接触性皮炎等（DE错）。